在《中国药典》中，盐酸美他环素含量测定的方法为
A. 碘量法
B. 汞量法
C. 酸碱滴定法
D. 紫外分光光度法
E. 高效液相色谱法

正确答案：E。高效液相色谱法